属于抑癌基因的是
A. Rb
B. ras
C. mys
D. c-erbB-2
E. sis

正确答案：A。Rb

解析：抑癌基因是一类能抑制细胞过度生长、增殖从而遏制肿瘤形成的基因。Rb基因是最早发现的肿瘤抑制基因（A对），其他的肿瘤抑制基因还有TP53、APC、DCC等。Ras（B错）、myc（C错）、c-erbB-2（D错）及sis（E错）均为人体内的细胞癌基因。通常，癌基因常以小写英文字母表示，而抑癌基因常以大写英文字母表示。